继承恒牙迟迟不萌出，乳牙保留在恒牙列内，X线上未见恒牙胚，应诊断为
A. 恒牙迟萌
B. 牙齿固连
C. 乳牙滞留
D. 异位萌出
E. 恒牙缺失

正确答案：E。恒牙缺失

解析：本题考查恒牙缺失。继承恒牙迟迟不萌出，乳牙保留在恒牙列内，X线上未见恒牙胚，应诊断为恒牙缺失（E对）。根据题目中的信息继承恒牙迟迟不萌出，乳牙保留在恒牙列内，X线上未见恒牙胚，可诊断为恒牙缺失。1.恒牙迟萌（A错）X线上可见恒牙胚。2.牙齿固连（B错）是牙骨质与牙槽骨的直接结合，固连部位牙周膜丧失，患牙的（牙合）面低于邻牙正常的（牙合）平面，有人称之为下沉牙或低（牙合）牙。X线表现为牙周膜消失，根骨连接处不清。3.乳牙滞留（C错）是指继承恒牙已萌出，未能按时脱落的乳牙，或恒牙未萌出，保留在恒牙列中的乳牙。4.牙齿异位萌出（D错）是指恒牙在萌出过程中未在牙列的正常位置萌出。牙齿的异位萌出多发生在上颌尖牙和上颌第一恒磨牙，其次是下颌侧切牙和第一恒磨牙。